根据藏药八性理论，治隆病采用的药物性能是
A. 热锐
B. 凉钝
C. 轻糙
D. 柔软
E. 重腻

正确答案：E。重腻

解析：本题考查的是藏药八性理论的内容。根据藏药八性理论，治隆病采用的药物性能是重腻（E对）。八性：重、腻、凉、钝、轻、糙、热、锐。八性源于五元，其中土元偏盛药物性能则重、腻；水元偏盛药物性能则凉、钝；火元偏盛药物性能则热、锐；风元偏盛药物性能则轻、糙。重、腻两性对治特性为轻、糙的隆病；凉、钝（B错）两性对治特性为热、锐的赤巴病；轻、糙（C错）、热、锐（A错）四性对治特性为重、柔、寒、钝的培根病。柔软（D错），属于十七效。十七效：柔、重、温、腻、稳、寒、钝、凉、软、稀、燥、干、热、轻、锐、糙、浮。